在完全寿命表中，如分析“15～”岁组的期望寿命，它反映的是
A. ≥15岁的死亡水平
B. 15～16岁的死亡水平
C. ≥0岁的死亡水平
D. ≤15岁的死亡水平
E. ≤16岁的死亡水平

正确答案：B。15～16岁的死亡水平

解析：本题考查完全寿命表的分组。寿命表中的年龄均采用实足年龄，完全寿命表的年龄组以每1岁为1组。如分析“15～”岁组的期望寿命，它反映的是15～16岁的死亡水平（B对ACDE错）。